被称为“卫生行政法规”的规范性文件的制定者是
A. 全国人民代表大会
B. 全国人民代表大会常务委员会
C. 国务院
D. 国务院有关部委
E. 各级人民政府

正确答案：C。国务院

解析：卫生行政法规是指由国务院制定发布的有关卫生方面的专门行政法规（C对D错），其法律效率低于卫生法律。全国人民代表大会（A错）及其常务委员会（B错）制定的是卫生法律。各级人民政府（E错）制定的是地方性卫生法规。